女性，24岁，发作性干咳3月，无发热、咯血、胸痛、胸闷，多次拍胸片未发现异常，反复用过“阿莫西林、阿奇霉素及止咳药”未见效，去年本季节（春天）曾有同样症状发作，曾服用过“氨茶碱”后完全缓解。查体：T37.2℃，P100次/分，R18次/分，BP120/75mmHg，双肺未闻及哮鸣音及湿啰音。该患者最可能的诊断是
A. 肺结核
B. 支原体肺炎
C. 支气管肺癌
D. 支气管哮喘
E. 慢性支气管炎

正确答案：D。支气管哮喘

解析：青年女性患者，发作性干咳3月，无发热、咯血、胸痛、胸闷，多次拍胸片未发现异常，反复用过“阿莫西林、阿奇霉素及止咳药”未见效（可排除肺部感染），去年本季节（春天）曾有同样症状发作，曾服用过“氨茶碱”后完全缓解（提示支气管哮喘），查体：T37.2℃（正常值为36.5℃～37.2℃），P100次/分（正常值为60～100次/分），R18次/分（正常值为16～20次/分），BP120/75mmHg（正常值为90～140/60～90mmHg），双肺未闻及哮鸣音及湿啰音，根据该患者的病史、临床症状及体征考虑最可能的诊断为支气管哮喘（D对），肺结核（A错）的临床表现为咳嗽、咳痰、低热、盗汗、乏力等典型症状，胸片也存在异常。支原体肺炎（B错）除有刺激性干咳外，还存在发热、乏力、头痛、咽痛、肌肉酸痛。支气管肺癌（C错）多见于40岁以上病人，可伴有咳嗽、咳痰、胸痛，痰中带血。 慢性支气管炎（E错）多见于老年人临床上以咳嗽、咳痰为主要症状，或有喘息，每年发病持续3个月或更长时间，连续2年或2年以上，并排除具有咳嗽、咳痰 喘息症状的其他疾病。